在腱反射中，梭外肌纤维属于
A. 感受器
B. 传入神经元
C. 神经中枢
D. 传出神经
E. 效应器

正确答案：E。效应器